多奈哌齐的药理作用是
A. 激动中枢阿片受体
B. 抑制中枢神经系统胆碱酯酶
C. 抑制纹状体单胺氧化酶
D. 阻断中枢神经系统胆碱受体
E. 激动黑质纹状体通路多巴胺受体

正确答案：B。抑制中枢神经系统胆碱酯酶

解析：本题考查多奈哌齐。多奈哌齐为乙酰胆碱脂酶抑制剂，通过抑制胆碱酯酶活性（B对），阻止乙酰胆碱的水解，提高脑内乙酰胆碱的含量，从而缓解因胆碱能神经功能缺陷所引起的记忆和认知功能障碍。激动中枢阿片受体（A错）的药物是阿片类镇痛药如吗啡、哌替啶。抑制纹状体单胺氧化酶（C错）的药物有抗抑郁药吗氯贝胺。阻断中枢神经系统胆碱受体（D错）的药物是苯海索。激动黑质纹状体通路多巴胺受体（E错）的药物是氯丙嗪。